不是从上颌神经翼腭窝段发出的神经是
A. 颧神经
B. 鼻腭神经
C. 腭后神经
D. 脑膜中神经
E. 上牙槽后神经

正确答案：D。脑膜中神经

解析：翼腭窝段：发出颧神经、翼腭神经（包括鼻腭神经和腭前、腭中、腭后神经）和上牙槽后神经。掌握“三叉神经的分支与分布”知识点。